外表面淡灰棕色或灰褐色，断面有细密、银白色、富弹性的橡胶丝相连，气微的药材是
A. 合欢皮
B. 秦皮
C. 白鲜皮
D. 杜仲
E. 地骨皮

正确答案：D。杜仲

解析：本题考查的是杜仲药材的性状鉴别。外表面淡灰棕色或灰褐色，断面有细密、银白色、富弹性的橡胶丝相连，气微的药材是杜仲（D对）。杜仲：【性状鉴别】药材呈板片状或两边稍向内卷，大小不一。外表面淡灰棕色或灰褐色，有明显的皱纹或纵裂槽纹，有的树皮较薄，未去粗皮，可见明显的斜方形皮孔，内表面暗紫色或紫褐色，光滑。质脆，易折断。断面有细密、银白色、富弹性的橡胶丝相连。气微，味稍苦。合欢皮（A错）：【性状鉴别】药材呈卷曲筒状或半筒状。外表面灰棕色至灰褐色，稍有纵皱纹，有的成浅裂纹，密生明显的椭圆形横向皮孔，棕色或棕红色，偶有突起的横棱或较大的圆形枝痕，常附有地衣斑；内表面淡黄棕色或黄白色，平滑，有细密纵纹。质硬而脆，易折断，断面呈纤维性片状，淡黄棕色或黄白色。气微香，味淡、微涩、稍刺舌，而后喉头有不适感。秦皮（B错）：【性状鉴别】药材枝皮呈卷筒状或槽状。外表面灰白色、灰棕色至黑棕色或相间呈斑状，平坦或稍粗糙，并有灰白色圆点状皮孔及细斜皱纹，有的具分枝痕。内表面黄白色或棕色，平滑。质硬而脆，断面纤维性，黄白色。气微，味苦。白鲜皮（C错）：【性状鉴别】药材呈卷筒状。外表面灰白色或淡灰黄色，具细纵皱纹及细根痕，常有突起的颗粒状小点；内表面类白色，有细纵纹。质脆，折断时有粉尘飞扬，断面不平坦，略呈层片状，剥去外层，迎光可见有闪烁的小亮点。有羊膻气，味微苦。地骨皮（E错）：【性状鉴别】药材呈筒状或槽状，外表面灰黄色至棕黄色，粗糙，有不规则纵裂纹，易成鳞片状剥落。内表面黄白色至灰黄色，较平坦，有细纵纹。体轻，质脆，易折断，断面不平坦。外层黄棕色，内层灰白色。气微，味微甘而后苦。